实施社区健康教育计划的质量控制，需要建立反馈系统，对计划活动不断进行监测和评估，下列哪项不是质量控制的内容
A. 对计划进程控制
B. 对健康教育活动监测
C. 对特定人群的知识、态度、行为及有关危险因素的监测
D. 对工作人员和特定人群的年龄、性别监测
E. 对经费开支监测

正确答案：D。对工作人员和特定人群的年龄、性别监测